小儿能坐时出现胸椎后凸是在
A. 3个月
B. 6个月
C. 9个月
D. 12个月
E. 6～7岁

正确答案：B。6个月

解析：6个月小儿能坐时出现胸椎后凸（第二个生理弯曲）。掌握“骨骼发育”知识点。